女，25岁。乏力伴刺激性干咳、咽痛、食欲不振1个月。近1周来低热，咳少量黏液痰。痰中带少量血丝。无寒战、盗汗。胸部X线片示两肺下野不规则片状浸润影。血清中支原体IgM抗体1：640阳性。治疗首选的药物种类是
A. 青霉素类
B. 碳青霉烯类
C. 头孢菌素类
D. 大环内酯类
E. 氨基糖苷类

正确答案：D。大环内酯类

解析：患者乏力、刺激性干咳、咽痛、低热，胸部X线片示两肺下野不规则片状浸润影。血清中支原体IgM抗体1：640阳性。考虑诊断为肺炎支原体肺炎。治疗首选的药物种类是大环内酯类抗生素（D对）。对大环内酯不敏感者则可选用呼吸氟喹诺酮类，如左氧氟沙星、莫西沙星等，四环素类也用于肺炎支原体肺炎的治疗。疗程一般2-3周。因肺炎支原体无细胞壁，青霉素（A错）或头孢菌素类（C错）等抗生素无效。